恶性程度高的甲状腺癌
A. 乳头状癌
B. 滤泡癌
C. 髓样癌
D. 未分化癌
E. 导管癌

正确答案：D。未分化癌

解析：恶性程度高的甲状腺癌未分化癌（D对）发展迅速，预后很差。恶性程度最低、预后最好的甲状腺癌为乳头状癌（A错）。滤泡癌肿瘤生长较快属中度恶性，预后不如乳头状癌（B错）。髓样癌恶性程度中等，预后不如乳头状癌（C错）。九版外科学教材中并未提及甲状腺癌有此病理类型（E错）。